我国现行生活饮用水水质卫生标准共规定了数十项指标，其中饮水铁不超过0.3mg/L，挥发性酚类（以苯酚计）不超过0.002mg/L，阴离子合成洗涤剂不超过0.3mg/L，这些指标属于
A. 特殊化学指标
B. 感官性状和毒理学指标
C. 一般化学指标和毒理学指标
D. 毒理学指标
E. 感官性状和一般化学指标

正确答案：E。感官性状和一般化学指标

解析：本题考查感官性状和一般化学指标。生活饮用水水质卫生标准中感官性状和一般化学指标（E对ABCD错）包括：色度、浑浊度、臭和味、肉眼可见物、pH、铝、铁、锰、铜、锌、氯化物、硫酸盐、溶解性总固体、总硬度、耗氧量、挥发酚类、阴离子合成洗涤剂等。